创立儿科“五脏证治法则”的专著是
A. 《颅囟经》
B. 《幼科发挥》
C. 《幼幼集成》
D. 《小儿药证直诀》
E. 《小儿卫生总微论方》

正确答案：D。《小儿药证直诀》

解析：北宋钱乙所著《小儿药证直诀》在辨证方面首创儿科五脏辨证体系，在治法上，从五脏补虚泄实出发干预治疗（D对）。《颅囟经》为相传至今最早的儿科专著，提出“纯阳”的观点，阐述小儿脉法、囟门诊察法（A错）。《幼科发挥》为明代儿科世医万全所著，倡导“育婴四法”（B错）。《幼幼集成》为清代陈复正所著，对指纹诊法颇有见地，提出“浮沉分表里，红紫辨寒热，淡滞定虚实”，“风轻、气重、命危”的观点（C错）。北宋的《小儿卫生总微论方》认为脐风的病因是断脐不慎所致，和成人破伤风为同一病源，提出烧灼法断脐的预防方法（E错）。